以下对维生素E描述错误的是
A. 具有抗氧化作用
B. 预防衰老作用
C. 构成机体组织的成分
D. 与动物的生殖功能有关
E. 具有调节血小板黏附力的作用

正确答案：C。构成机体组织的成分